固定义齿基牙为以下情况时，应当考虑增加基牙数目的是
A. 单根牙
B. 轻度倾斜
C. 临床牙冠较短
D. 牙槽骨吸收达根长1/2
E. 无对（牙合）功能

正确答案：D。牙槽骨吸收达根长1/2

解析：基牙牙根应该粗壮并有足够的长度。牙槽骨吸收最多不超过根长的1/3，个别特殊病例条件放宽吸收不可超过根长的1/2，如选用其作为基牙，必须增加基牙数量。掌握“固定桥的生理基础”知识点。